成年人受到持续寒冷刺激时，产热量大为增加的主要方式是
A. 肝脏代谢增强
B. 基础代谢增强
C. 肌紧张产热
D. 骨骼肌代谢增强
E. 褐色脂肪组织产热

正确答案：D。骨骼肌代谢增强

解析：在寒冷环境中由于散热量增加，机体主要依靠战栗产热和非战栗产热来增加产热量。非战栗产热最强的组织是褐色脂肪，新生儿体内则较多，另外由于新生儿因体温调节功能尚不完善，不能发生战栗，故褐色脂肪组织产热（E错）对新生儿的意义尤为重要，成年人产热量大为增加的主要方式是战栗产热，骨骼肌代谢增强（D对）。机体在安静时主要由内脏产热，其中以肝脏代谢（A错）最为旺盛。基础代谢（B错）是指基础状态下的能量代谢，与成年人受到持续寒冷刺激时的产热量没有关系。肌紧张（C错）的生理意义在于维持姿势反射，与成年人受到持续寒冷刺激时的产热量没有关系。